霍纳综合征的临床表现是
A. 眼裂正常，瞳孔扩大，直接对光反射迟钝
B. 眼裂扩大，瞳孔缩小，直接对光反射正常
C. 眼裂变小，瞳孔缩小，直接对光反射正常
D. 眼裂变小，瞳孔正常，直接对光反射正常
E. 眼裂变小，瞳孔扩大，直接对光反射消失

正确答案：C。眼裂变小，瞳孔缩小，直接对光反射正常

解析：霍纳综合征是由于颈部交感神经受损，引起瞳孔缩小（ADE错）、但对光反应正常（C对），病侧眼球内陷、上睑下垂（ABE错）及患侧面部少或无汗等表现的综合征。